含右美沙芬制剂的禁用人群是
A. 干咳患者
B. 银屑病患者
C. 呼吸衰竭患者
D. 妊娠3个月妇女
E. 糖尿病患者

正确答案：D。妊娠3个月妇女

解析：本题考查右美沙芬的禁忌症。右美沙芬为中枢性镇咳药，禁用于妊娠期妇女（D对）、昏迷、呼吸困难、有精神病史的患者。